男，70岁。咳嗽、咳痰、喘息10余年，再发加重2周。查体：双肺底部可闻及少许湿啰音。动脉血气分析：pH7.30，PaCO₂70mmHg，PaO₂46mmHg。入院后立即给予持续低流量鼻导管吸氧。采取此吸氧方式最重要的目的是
A. 保持CO₂对呼吸中枢的刺激
B. 保持低氧及CO₂对呼吸中枢的刺激
C. 保持低氧对呼吸中枢的刺激
D. 保持CO₂对颈动脉体化学感受器的刺激
E. 保持低氧对颈动脉体化学感受器的刺激

正确答案：E。保持低氧对颈动脉体化学感受器的刺激

解析：老年男性患者，咳嗽、咳痰、喘息，再发加重，双肺底部可闻及少许湿啰音（提示肺部有炎症）。查血气分析：PaCO₂70mmHg（＞50mmHg），PaO₂46mmHg（＜60mmHg），综合患者病史、临床表现、体征及血气分析检查，考虑诊断为1.COPD加重；2.Ⅱ型呼吸衰竭。COPD患者常伴CO₂潴留，病人呼吸中枢对CO₂反应性差，主要靠低氧血症对颈动脉体、主动脉体化学感受器的刺激来维持。若吸入高浓度氧，使血氧迅速上升，解除了低氧对外周化学感受器的刺激（E对），便会抑制病人呼吸，造成通气状况进一步恶化，导致CO₂上升，严重时陷入CO₂麻醉状态，因此，入院后应立即给予持续低流量鼻导管吸氧（E对）。